在牙齿发育期间,由于全身疾病、营养障碍或严重的乳牙根尖周感染,导致的釉质结构异常称为
A. 四环素牙
B. 牙本质发育不全
C. 牙釉质发育不全
D. 桑葚牙
E. 牙内陷

正确答案：C。牙釉质发育不全

解析：本题考查牙釉质发育不全。在牙齿发育期间,由于全身疾病、营养障碍或严重的乳牙根尖周感染,导致的釉质结构异常称为牙釉质发育不全（C对）。1.牙釉质发育不全指在牙发育期间，由于全身疾患、营养障碍或严重的乳牙根尖周感染导致牙釉质结构异常。根据致病的性质不同，有牙釉质形成不全和牙釉质矿化不全两种表现形式：前者系牙釉质基质形成障碍所致，临床上常有实质缺损；后者则为基质形成正常而矿化不良所致，临床上一般无实质缺损。2.四环素族药物引起牙着色称为四环素牙（A错）；四环素沉积于牙、骨骼以及指甲等，而且还能引起牙釉质发育不全。3.牙本质发育不全（B错）是一种牙本质发育异常的常染色体显性遗传疾病。4.先天性梅毒牙包括半月形切牙和桑葚状磨牙（D错）等。主要见于恒牙，乳牙极少受累。10%～30%的先天性梅毒患者有牙表征。4.牙内陷（E错）为牙发育时期，成釉器过度卷叠或局部过度增殖，深入到牙乳头中所致。牙萌出后，在牙面可出现一囊状深陷的窝洞。常见于上颌侧切牙，偶发于上颌中切牙或尖牙。根据牙内陷的深浅程度及其形态变异，临床上可分为畸形舌侧窝、畸形根面沟、畸形舌侧尖和牙中牙。